毒物一次或短时间内大量进入人体后可引起
A. 急性反应
B. 亚急性反应
C. 急性中毒
D. 慢性中毒
E. 慢性反应

正确答案：C。急性中毒